《医疗机构从业人员行为规范》提出的医疗机构从业人员执业的价值目标是
A. 为人民健康服务
B. 发扬人道主义精神
C. 树立大医精诚理念
D. 以患者为中心
E. 救死扶伤、防病治病

正确答案：A。为人民健康服务

解析：社会公益思想的广泛传播和深入影响，要求医务人员将病人的利益与社会利益、近期利益与长远利益结合起来，将社会群体和人类后代的生命健康作为自己工作的重要目标。医疗机构从业人员的职业价值目标是为人民健康服务（A对）。